28岁初产妇，妊娠39周，枕右前位。阵发性腹痛9小时，宫缩9分钟一次，持续35秒，宫口开大2cm。出现上述临床表现最可能的原因是
A. 子宫收缩节律性异常
B. 子宫收缩对称性异常
C. 子宫收缩极性异常
D. 子宫收缩缩复作用异常
E. 腹肌和膈肌收缩力异常

正确答案：A。子宫收缩节律性异常

解析：该产妇宫口开大2cm，经历9小时（＜16小时），说明处于潜伏期，宫缩9分钟一次（＞5-6分钟），持续35秒（＞30秒），故最可能的原因是子宫收缩节律异常（A对）。子宫收缩对称性异常（B错）不会出现宫缩节律的异常。子宫收缩极性异常（C错）表现为子宫收缩的兴奋点不是起自两侧宫角，而是来自子宫下段的一处或多处冲动，与该病例不符，故不是宫缩极性的异常。子宫收缩缩复作用异常（D错）、腹肌和膈肌收缩力异常（E错）均无宫缩节律的异常。